某医科大学附属医院进行一项新药物治疗高血压的临床试验，分析时最好选用的指标是
A. 有效率、不良反应发生率
B. 相对危险度、特异危险度
C. 发病率死亡率
D. 保护率、效果指数
E. 抗体阳性率、发病率

正确答案：A。有效率、不良反应发生率

解析：本题考查考查实验流行病学的评价指标。评价治疗措施效果的主要指标有：有效率、治愈率、N年生存率。进行新药物治疗高血压的临床试验，分析时最好选用的指标是有效率、不良反应发生率（A对BCDE错）。